男，45岁。3天前突然出现发热、头痛、嗜睡，随后出现兴奋话多，语言凌乱，说在墙壁上看到了妖怪，有人要害他等。患者所处的状态是
A. 焦虑状态
B. 幻觉状态
C. 谵妄状态
D. 昏迷状态
E. 躁狂状态

正确答案：C。谵妄状态

解析：该男性患者，3天前突然出现发热、头痛、嗜睡（意识清晰度降低），随后看到了妖怪（恐怖性幻视），故诊断为谵妄状态（C对）。焦虑状态以焦虑为主要表现，患者常常有不明原因的提心吊胆、紧张不安，与本例不符，故不考虑（A错）。